神经垂体贮存的激素是
A. 促甲状腺激素
B. 抗利尿激素
C. 生长激素
D. 促肾上腺皮质激素
E. 促性腺激素

正确答案：B。抗利尿激素

解析：神经垂体不含腺细胞，所以不能合成激素，神经垂体激素是由视上核和室旁核等处合成并运输到神经垂体储存的，包括血管升压素（VP）和缩宫素（OT），VP也称抗利尿激素（B对）。腺垂体可以分泌7种激素：①促甲状腺激素（A错）②生长激素（C错）③促肾上腺皮质激素（D错）④促性腺激素（E错），促性腺激素又包括卵泡刺激素和黄体生成素⑤催乳素⑥促黑素（P381）。